合金与纯金属性质相比
A. 合金的熔点较凝固点高
B. 合金的硬度较其所组成的纯金属高
C. 合金的抗腐蚀性能较纯金属高
D. 合金的传导性较原有金属好
E. 合金的延展性较所组成的金属高

正确答案：B。合金的硬度较其所组成的纯金属高

解析：本题考查合金的特性。合金硬度较其所组成的金属高（B对）。合金没有固定的熔点和凝固点，因此不能将合金的熔点和凝固点进行比较（A错）。纯金属一般不易被腐蚀，合金的腐蚀性一般视其结构及组成的不同而异。在合金中加入一定量的抗腐蚀元素如铬、镍、锰和硅等，可提高合金的耐腐蚀性，即合金的抗腐蚀性较纯金属低（C错）。合金的传导性一般均较组成的金属差，其中尤以导电性减弱更为明显（D错）。合金的延展性一般均较所组成的金属为低（E错）。